关于胶囊剂的说法正确的有
A. 肠溶胶囊剂不溶于胃液但能在肠液中崩解释放药
B. 控释胶囊应在规定的释放介质中缓慢地恒速释放药物
C. 缓释胶囊应在规定的释放介质中缓慢地非恒速地释放药物
D. 硬胶囊内容物可以是药物的均匀粉末、细小颗粒、小丸
E. 软胶囊俗称胶丸，其制法有滴制法和压制法

正确答案：A、B、C、D、E。肠溶胶囊剂不溶于胃液但能在肠液中崩解释放药；控释胶囊应在规定的释放介质中缓慢地恒速释放药物；缓释胶囊应在规定的释放介质中缓慢地非恒速地释放药物；硬胶囊内容物可以是药物的均匀粉末、细小颗粒、小丸；软胶囊俗称胶丸，其制法有滴制法和压制法

解析：本题考查的是胶囊剂的含义与分类。关于胶囊剂的说法正确的有肠溶胶囊剂不溶于胃液但能在肠液中崩解释放药（A对）、控释胶囊应在规定的释放介质中缓慢地恒速释放药物（B对）、缓释胶囊应在规定的释放介质中缓慢地非恒速地释放药物（C对）、硬胶囊内容物可以是药物的均匀粉末、细小颗粒、小丸（D对）与软胶囊俗称胶丸，其制法有滴制法和压制法（E对）。胶囊剂系指原料药物或与适宜辅料充填于空心胶囊或密封于软质囊材中制成的固体制剂。胶囊剂可分为硬胶囊、软胶囊（胶丸）、缓释胶囊、控释胶囊和肠溶胶囊，主要供口服用。也可外用于直肠、阴道等部位。（1）硬胶囊（通称为胶囊）：系指采用适宜的制剂技术，将原料药物或加适宜辅料制成的均匀粉末、颗粒、小片、小丸、半固体或液体等，充填于空心胶囊中的胶囊剂。（2）软胶囊：系指将一定量的液体原料药物直接包封，或将固体原料药物溶解或分散在适宜的辅料中制备成溶液、混悬液、乳状液或半固体，密封于软质囊材中的胶囊剂。软胶囊又称胶丸，可用滴制法或压制法制备。（3）缓释胶囊：系指在规定的释放介质中缓慢地非恒速释放药物的胶囊剂。（4）控释胶囊：系指在规定的释放介质中缓慢地恒速释放药物的胶囊剂。（5）肠溶胶囊：系指用肠溶材料包衣的颗粒或小丸充填于胶囊而制成的硬胶囊，或用适宜的肠溶材料制备而得的硬胶囊或软胶囊。